早产最常见的病因是
A. 遗传因素
B. 头盆不称
C. 子宫畸形
D. 子痫前期
E. 下生殖道感染

正确答案：E。下生殖道感染

解析：早产的常见诱因：①宫内感染，30%~40%的早产，常伴胎膜早破、绒毛膜羊膜炎；②泌尿生殖道感染（E对），B族链球菌、沙眼衣原体、支原体致下生殖道感染、细菌性阴道病、无症状性菌尿、急性肾盂肾炎等。